通过细胞膜受体发挥作用的激素是
A. 雌激素
B. 孕激素
C. 糖皮质激素
D. 甲状腺素
E. 胰岛素

正确答案：E。胰岛素